心肾不交的治法是
A. 泻南补北
B. 扶土抑木
C. 滋水涵木
D. 培土生金
E. 佐金平木

正确答案：A。泻南补北

解析：因心主火，火属南方；肾主水，水属北方，故称泻南补北法（A对）。肾阴不足，心火偏旺，水火不济，心肾不交证，由于心火独亢于上，不能下交于肾，应以泻心火为主；因肾水不足，不能上奉于心，应以滋肾水为主。